有在高氟区生活史，且恒牙症状较严重，但是乳牙症状相对较轻的牙釉质结构异常的疾病为
A. 氟斑牙
B. 四环素牙
C. 特纳牙
D. 遗传性乳光牙本质
E. 哈钦森牙

正确答案：A。氟斑牙

解析：因为有胎盘屏障，故氟不易穿过胎盘造成乳牙的氟牙症，但恒牙会受到影响。掌握“四环素牙”知识点。